文字为主的材料如果是比较大的范围使用，若采取小组访谈方法进行预试验，至少需要（）个预试验地点进行
A. 1
B. 2
C. 3
D. 4
E. 5

正确答案：C。3